生后15个月开始
A. 发出喉音
B. 咿呀发音
C. 能懂“再见”
D. 开始用单词
E. 能说出自己的名字

正确答案：E。能说出自己的名字

解析：新生儿已会哭叫，2个月发喉音，3～4个月咿呀发音，5～6个月会发单音，7～8个月能无意识发出复音，如“爸爸”、“妈妈”，9个月能听懂“再见”等，10～11个月能模仿成人的动作，如再见等，开始说单词，1～1.5岁能说出物品及自己的名字，认识并指出身体的各部位；2岁用简单的语言表达自己的需要，对人、事有喜乐之分；3岁以后词汇增多，说话也逐渐流利。掌握“运动和语言发育”知识点。